隐蔽的自身抗原是
A. 肿瘤抗原
B. ABO血型抗原
C. Rh血型抗原
D. HLA分子
E. 睾丸内容物

正确答案：E。睾丸内容物

解析：本题考查隐蔽的自身抗原。由于解剖位置特殊，机体内某些抗原从胚胎期开始从未与机体免疫系统接触，称为隐蔽抗原。隐蔽抗原通常不引发自身免疫反应，这类抗原有晶状体、睾丸（E对）、精（卵）子和中枢神经系统的抗原等。